在卫生条件不完善的宾馆、旅店住宿的顾客容易患的疾病主要是
A. 寄生虫病
B. 军团菌病
C. 心脏病、高血压
D. 肺结核、中耳炎
E. 糖尿病

正确答案：B。军团菌病

解析：本题考查在卫生条件不完善的宾馆、旅店住宿的顾客容易患的疾病。在卫生条件不完善的宾馆、旅店住宿的顾客容易患的疾病主要有：空调中不清洁空气引起的军团病（B对ACDE错）；卫生间不清洁还会传播性病、皮肤病等；地毯等不经常打扫导致尘螨引起的过敏症等；饮食和饮水不卫生会导致腹泻、肝炎、细菌性痢疾、伤寒等疾病。